肛诊检查触及黏膜外条索状肿物，质地稍硬、固定，最可能是
A. 肛裂
B. 直肠癌
C. 肛瘘
D. 内痔
E. 直肠息肉

正确答案：C。肛瘘

解析：肛诊检查触及到黏膜外条索状肿物，质硬、固定，位于肠腔内，考虑肛瘘（C对）。肛裂行肛指检查时，常引起剧烈疼痛，退出可见手套染血（A错）。直肠癌在肛管或示指可及的直肠可扪及高低不平的硬结，不规则肿物（B错）。内痔一般柔软不易扪及（D错）。直肠息肉肛指检查扪及质软可推动的的圆形肿块（E错）。